全口义齿戴牙后，下颌髁突明显向后上位移，主要由于
A. 正中（牙合）错位
B. 垂直距离过低
C. 垂直距离过高
D. 义齿咬合关系不佳
E. 义齿变形

正确答案：B。垂直距离过低

解析：全口义齿戴牙后，下颌髁突明显向后上位移，主要由于垂直距离过低（B对）。垂直距离过低，即息止（牙合）间隙过大，患者实际处于一种闭口状态，则下颌髁突明显向后上位移。垂直距离过高（C错），息止（牙合）间隙变小，患者处于一种被动张口状态，下颌髁突向前下位移。义齿咬合关系不佳（D错）会使义齿在正中（牙合）和侧方（牙合）时有早接触或干扰，导致（牙合）力分布不均，不会造成髁突明显移位。正中（牙合）错位（A错）影响全口义齿稳定性，不会引起明显移位。义齿变形（E错）会影响义齿稳定性，不会导致下颌髁突明显向后上位移。